以下属于酸蚀症的生物性因素的是
A. 喝碳酸饮料
B. 反应经性呕吐
C. 胃病
D. 唾液缓冲能力下降
E. 吃含铁性药物

正确答案：D。唾液缓冲能力下降

解析：本题考查酸蚀症的危险因素。以下属于酸蚀症的生物性因素的是唾液缓冲能力下降（D对）。酸蚀症的危险因素有(1)化学因素：主要指接触牙的酸性物质。内源性酸(胃酸)：胃食管反流性疾病（B错）、 胃肠紊乱）（C错）。外源性酸：饮食因素（A错）、药物因素（E错）、环境因素。(2)生物因素：唾液的缓冲能力、获得性膜、牙的结构和矿化程度、牙和软组织的位置关系等。(3)行为因素：生活方式、口腔卫生习惯。